tRNA含有
A. 3'-CCA-OH
B. 帽子m⁷Gppp
C. 密码子
D. 3'-末端的多聚腺苷酸结构
E. 大、小两个亚基

正确答案：A。3'-CCA-OH